螺内酯安体舒通利尿作用的机制是
A. 抑制肾小球滤过
B. 直接抑制肾小管H⁺-Na⁺交换
C. 直接抑制肾小管K⁺-Na⁺交换
D. 抑制碳酸酐酶活性
E. 拮抗醛固酮的作用

正确答案：E。拮抗醛固酮的作用

解析：螺内酯的药理作用：螺内酯及其代谢产物的结构均与醛固酮相似，能与远曲小管远端和集合管细胞浆内的醛固酮受体相结合，竞争性拮抗醛固酮的作用，使远曲小管和集合管的K⁺-Na⁺交换减少，具有排钠留钾的利尿作用（E对）。